在乙型肝炎患者血清中，不能检测到的乙肝病毒标记物是
A. HBsAg
B. 抗-HBs
C. HBeAg
D. HBcAg
E. 抗-HBc

正确答案：D。HBcAg

解析：在乙型肝炎患者血清中，不能检测到的乙肝病毒标记物是HBcAg（D错，为本题正确答案），因血液中HBcAg主要存在于Dane颗粒的核心，游离的HBcAg极少，故较少用于临床常规检测。HBsAg（A对）最早l～2周出现在感染HBV后 ，最迟11～12周，急性自限性HBV感染时血中HBsAg大多持续1～6周，最长可达20周。无症状携带者和慢性患者HBsAg可持续存在多年，甚至终身；抗-HBs（B对）在急性感染后期，HBsAg转阴后一段时间开始出现，在6～12个月内逐步上升至高峰，可持续多年，但滴度会逐步下降。HBeAg（C对）是一种可溶性蛋白，一般仅见于HBsAg阳性血清，急性HBV感染时HBeAg的出现时间略晚于HBsAg。抗-HBc（E对）在HBV感染者体内几乎均可检测出，抗HBcIgM是HBV感染后较早出现的抗体，绝大多数出现在发病第一周，多数在6个月内消失，抗HBcIgM阳性提示急性期或慢性肝炎急性发作。抗HBcIgG出现较迟，但可保持多年甚至终身。